长期使用会造成牙色素沉积的药物牙膏是
A. 全效牙膏
B. 洗必泰牙膏
C. 脱敏牙膏
D. 氟化亚锡牙膏
E. 增白牙膏

正确答案：B。洗必泰牙膏

解析：洗必泰为化学制剂控制菌斑，副作用表现在：能使牙、修复体或舌背上发生染色，特别是树脂类修复体的周围和牙面龈1/3处，易染成棕黄色，只沉积在牙表面，不透入牙内。掌握“自我口腔保健方法”知识点。